肉桂具有的功效是
A. 疏肝下气
B. 回阳救逆
C. 两者均是
D. 两者均不是

正确答案：D。两者均不是

解析：本题考查的是肉桂的功效。肉桂具有的功效是补火助阳，引火归元，散寒止痛，温通经脉（D对）。肉桂：【功效】补火助阳，引火归元，散寒止痛，温通经脉。吴茱萸：【功效】散寒止痛，疏肝下气（A错），燥湿止泻。附子：【功效】回阳救逆（B错），补火助阳，散寒止痛。